感染转为局限性化脓的主要原因是
A. 人体抵抗力占优势
B. 病灶局部组织血循环障碍
C. 病灶仍有大量细菌
D. 抗生素使用剂量不足
E. 致病菌毒力强大

正确答案：A。人体抵抗力占优势

解析：非特异性感染的结局有4种，即炎症好转、局限化脓、炎症扩展和转为慢性炎症。炎症好转或转化为局限性化脓是人体抵抗力占优势的表现（A对）。若病灶局部组织血循环障碍（B错），则感染有可能转化为坏疽。病灶仍有大量细菌（C错）、抗生素使用剂量不足（D错）、致病菌毒力强大（E错），有可能使感染迅速扩散。